某女，35岁。近来小便热涩刺痛、尿色深红、小腹拘急疼痛、心烦，舌尖红，苔黄，脉滑数，医师辨证为血淋，宜选用的中药有
A. 瞿麦
B. 蒲黄
C. 滑石
D. 海金沙
E. 茯苓

正确答案：A、B、D。瞿麦；蒲黄；海金沙

解析：本题考查瞿麦、蒲黄、海金沙的主治。某女，35岁。近来小便热涩刺痛、尿色深红、小腹拘急疼痛、心烦，舌尖红，苔黄，脉滑数，医师辨证为血淋，宜选用的中药有瞿麦（A对）、蒲黄（B对）、海金沙（D对）。瞿麦【功效】利尿通淋，破血通经。【主治病证】（1）热淋，血淋，石淋。（2）瘀血闭经。海金沙【功效】利尿通淋，止痛。【主治病证】（1）热淋，血淋，石淋，膏淋。（2）水肿。蒲黄【功效】活血祛瘀，收敛止血，利尿通淋。【主治病证】（1）吐血，咳血，衄血，尿血，便血，崩漏，外伤出血。（2）血瘀之心腹疼痛、痛经，产后瘀阻腹痛。（3）血淋涩痛。滑石（C错）【功效】利尿通淋，清解暑热；外用清热收湿敛疮。【主治病证】（1）湿热淋证，小便不利。（2）暑热烦渴，湿温胸闷，湿热泄泻。（3）湿疮，湿疹，痱子。茯苓（E错）【功效】利水渗湿，健脾，安神。【主治病证】（1）小便不利，水肿，痰饮。（2）脾虚证，兼便溏或泄泻者尤佳。（3）心悸，失眠。